含有马兜铃酸的中药有
A. 甘草
B. 薄荷
C. 马兜铃
D. 细辛
E. 人参叶

正确答案：C、D。马兜铃；细辛

解析：本题考查的是含马兜铃酸的中药。含有马兜铃酸的中药有马兜铃（C对）与细辛（D对）。含有马兜铃酸的中药有马兜铃、关木通、广防己、细辛、天仙藤、青木香、寻骨风等。甘草（A错）与人参叶（E错）含皂苷类成分。薄荷（B错）含挥发油类成分。